根据磺酰脲类降糖药的构效关系，当脲上取代基为甲基环己基时，甲基阻碍了环己烷上的羟基化反应，因此具有高效、长效降血糖作用。下列降糖药中，具有上述结构特征的是
A. 格列齐特
B. 格列本脲
C. 格列吡嗪
D. 格列喹酮
E. 格列美脲

正确答案：E。格列美脲

解析：本题考查磺酰脲类胰岛素分泌促进剂类降糖药。格列美脲（E对）脲上的取代基为甲基环己基，甲基处在环己烷的平伏键上，阻碍了环己烷上的羟基化反应，因此具有高效、长效降血糖作用；格列齐特（A错）是将甲苯磺丁脲分子中脲上丁基以八氢环戊烷并吡咯取代得到的；格列本脲（B错）、格列吡嗪（C错）、格列喹酮（D错）脲上的取代基为环己基。